下列属于社区卫生服务原则的是
A. 协同性
B. 发展性
C. 经济性
D. 公平性
E. 以上都是

正确答案：E。以上都是

解析：本题考查社区卫生服务的原则。社区卫生服务要兼顾协同性、发展性、经济性和公平性的原则。本题中以上均是（E对ABCD错）社区卫生服务的原则。